治疗肺痨虚火灼肺的最佳选方是
A. 保真汤
B. 百合固金丸
C. 月华丸
D. 补天大造丸
E. 补肺阿胶汤

正确答案：B。百合固金丸

解析：虚火灼肺证之肺痨是由肺肾阴伤，水亏火旺，燥热内灼，络损血溢所致，治疗应该用百合固金汤合秦艽鳖甲散以达到滋阴降火的目的（B对）。保真汤益气养阴，为气阴耗伤证之肺痨的代表方（A错）。月华丸滋阴润肺，为肺阴亏损证之肺痨的代表方（C错）。补天大造丸滋阴补阳，为阴阳虚损证之肺痨的代表方（D错）。补肺阿胶汤养阴补肺，清热止血，用于小儿肺虚有热证（E错）。